含有咪唑并吡啶杂环，具弱碱性，口服在胃肠道迅速吸收的药物是
A. 奥沙西泮
B. 三唑仑
C. 唑吡坦
D. 艾司佐匹克隆
E. 扎来普隆

正确答案：C。唑吡坦

解析：本题考查唑吡坦。唑吡坦（C对）为含有咪唑并吡啶结构的镇静催眠药，具弱碱性，口服在胃肠道迅速吸收。奥沙西泮（A错）为苯骈二氮杂䓬结构；三唑仑（B错）含甲基三唑杂环；艾司佐匹克隆（D错）结构为吡咯烷酮；扎来普隆（E错）结构中含有吡唑并嘧啶杂环，以上四种均不具有咪唑并吡啶杂环的结构。